下列哪项不属于盆腔淋巴结
A. 腹股沟深淋巴结
B. 腰淋巴结
C. 髂内淋巴结
D. 髂外淋巴结
E. 髂总淋巴结

正确答案：A。腹股沟深淋巴结

解析：盆腔淋巴分为3组：髂淋巴组：由闭孔、髂内（C对）、髂外（D对）及髂总（E对）淋巴结组成，收集来自阴道上部、宫颈、子宫及膀胱的淋巴。②骶前淋巴组：位于骶骨前面，收集来自直肠、阴道后壁及子官等的淋巴。③腰淋巴组（B对）：也称腹主动脉旁淋巴组，位于腹主动脉旁，收集宫体、宫底、输卵管及卵巢的淋巴（A错，为本题正确答案）。